四环素对人体的骨和牙齿有亲和性，所以牙齿磨片中的色素条带在紫外线下可显示
A. 明亮的绿色荧光
B. 明亮的黄色荧光
C. 明亮的紫色荧光
D. 明亮的蓝色荧光
E. 明亮的红色荧光

正确答案：B。明亮的黄色荧光

解析：四环素牙磨片上，牙本质上的色素条带在紫外线下可显示明亮的黄色荧光。掌握“四环素牙”知识点。